《中小学教室采光和照明卫生标准》要求，中小学校教室窗透光面积与地面积之比（玻地面积比）应不低于
A. 1∶2
B. 1∶3
C. 1∶4
D. 1∶5
E. 1∶6

正确答案：E。1∶6